对应用镇痛药治疗癌痛，许多学者采用WHO推荐的阶梯镇痛疗法，一般采用可待因或其他弱阿片类药物属于
A. 第一阶梯
B. 第二阶梯
C. 第三阶梯
D. 第四阶梯
E. 第五阶梯

正确答案：B。第二阶梯

解析：首选非甾体抗炎药（第一阶梯），主要针对轻度和中度的周围性癌痛；当这类药物不能满意地止痛时，则采用可待因或其他弱阿片类药物（第二阶梯）。掌握“全身麻醉”知识点。